女，35岁，初产妇。妊娠36周，血压升高1个月，持续腹痛伴阴道少量流血3小时。查体：T36℃，P120次/分，R28次/分，BP90/60mmHg，神志清楚，全身水肿。子宫硬如板状，胎方位不清，胎心未闻及，宫口2cm，先露-2cm.最有效的处理措施是
A. 硫酸镁抑制宫缩
B. 人工破膜引产
C. 缩宫素引产
D. 立即剖宫产
E. 镇静止痛

正确答案：D。立即剖宫产

解析：胎盘早剥治疗原则为早期识别、积极处理休克、及时终止妊娠、控制DIC、减少并发症。该孕妇持续腹痛伴阴道少量流血3小时，出现体温降低、脉搏及呼吸加快、血压下降等休克症状。腹部检查见子宫硬如板状，胎方位不清，胎心消失，考虑为Ⅲ度胎盘早剥，符合剖宫产（D对）指征。硫酸镁（A错）常用于防治子痫和抑制宫缩以治疗早产和前置胎盘等。人工破膜引产（B错）适用于Ⅰ度胎盘早剥患者，一般情况良好，病情较轻，必要时可滴注缩宫素引产（C错）。镇静止痛（E错）属于一般治疗，不是治疗Ⅲ度胎盘早剥的最有效措施。